疱疹病毒不包括
A. HSV
B. VZV
C. CMV
D. HBV
E. EBV

正确答案：D。HBV

解析：疱疹病毒科共有100种以上的病毒，均为圆球状、有包膜、直径为150～200nm的线性双链DNA（dsDNA）病毒。其中对人有重要意义的主要为人类疱疹病毒1型（HHV-1）或称单纯疱疹病毒1型（HSV-1）、人类疱疹病毒2型（HHV-2）或称单纯疱疹病2型（HSV-2）、人类疱疹病毒3型（HHV-3）或称水痘-带状疱疹病毒（VZV）、人类疱疹病毒4型（HHV-4）或称EB病毒（EBV）以及人类疱疹病毒5型（HHV-5）或称人巨细胞病毒（CMV）等。掌握“疱疹病毒”知识点。